属于Ⅳ型超敏反应导致的疾病是
A. 接触性皮炎
B. 新生儿溶血病
C. 支气管哮喘
D. 荨麻疹
E. 链球菌感染后肾小球肾炎

正确答案：A。接触性皮炎

解析：接触性皮炎为典型的接触性迟发型超敏反应，通常是由于接触小分子半抗原物质，如油漆、染料、农药、化妆品和某些药物（磺胺和青霉素）等引起，小分子的半抗原与体内蛋白质结合成全抗原，经朗格汉斯细胞摄取并提呈给T细胞，使其活化、分化为效应T细胞和记忆T细胞，机体再次接触相应抗原后刺激特异性T细胞活化，产生一系列细胞因子，介导组织炎症损伤，局部皮肤出现水肿等反应。Ⅱ型超敏反应导致的疾病有输血反应、新生儿溶血病（B错）、药物过敏性血细胞减少症等。支气管哮喘、荨麻疹（CD错）属于Ⅰ型超敏反应。链球菌感染后肾小球肾炎（E错）属于Ⅲ型超敏反应。